下列不属于典型流行性出血热临床分期的是
A. 发热期
B. 稳定期
C. 少尿期
D. 多尿期
E. 恢复期

正确答案：B。稳定期

解析：流行性出血热潜伏期为4-46天，一般为7-14天。典型病例有五期，包括发热期，低血压休克期，少尿期，多尿期和恢复期（B对）。发热期，主要是表现为发热，全身中毒症状和毛细血管损伤以及肾的损伤。低血压休克期一般发生在第4-6天，此期可以由于长期组织供血不足，可以出现发绀，促使DIC，脑水肿，急性呼吸窘迫征和急性肾衰竭发生。少尿期常继低血压休克期而出现也可以直接由发热期直接进入本期。多尿期一般在病程第9-14天，多尿期又分为移行期，多尿早期，多尿后期。恢复期经多尿期后，尿量逐渐恢复为2000mL以下，精神食欲基本恢复，一般需要1-3个月才能完全恢复。